某女，35岁，半年来，月经期提前，经量较多，净色红质稀，腰膝酸软，五心烦热，证属阴虚血热，治当滋阴清热、养血调经，宜选用的成药是
A. 白带丸
B. 妇科十味片
C. 安坤颗粒
D. 千金止带丸
E. 花红颗粒

正确答案：C。安坤颗粒

解析：本题考查的是安坤颗粒的功能与主治。半年来，月经期提前，经量较多，净色红质稀，腰膝酸软，五心烦热，证属阴虚血热，治当滋阴清热、养血调经，宜选用的成药是安坤颗粒（C对）。安坤颗粒：【功能】滋阴清热，养血调经。【主治】阴虚血热所致的月经先期、月经量多、经期延长，症见月经期提前、经量较多、行经天数延长、经色红质稀、腰膝酸软、五心烦热；放节育环后出血见上述证候者。白带丸（A错）：【功能】清热，除湿，止带。【主治】湿热下注所致的带下病，症见带下量多、色黄、有味。妇科十味片（B错）：【功能】清热除湿，益气化瘀。【主治】湿热瘀阻所致的带下病、腹痛，症见带下量多、色黄质稠、臭秽、小腹疼痛、腰骶酸痛、神疲乏力；慢性盆腔炎、子宫内膜炎、慢性宫颈炎见有上述证候者。千金止带丸（D错）：【功能】健脾补肾，调经止带。【主治】脾肾两虚所致的月经不调、带下病，症见月经先后不定期、量多或淋沥不净、色淡无块，或带下量多、色白清稀、神疲乏力、腰膝酸软。花红颗粒（E错）：【功能】清热解毒，燥湿止带，祛瘀止痛。【主治】湿热瘀滞所致带下病、月经不调，症见带下量多、色黄质稠、小腹隐痛、腰骶酸痛、经行腹痛；慢性盆腔炎、附件炎、子宫内膜炎见有上述证候者。